HLB值在8～16之间的表面活性剂可作为
A. 增溶剂
B. O/W型乳化剂
C. W/O型乳化剂
D. 消泡剂
E. 润湿剂

正确答案：B。O/W型乳化剂